静脉注射某药80mg，初始血药浓度为20mg/L，则该药的表观分布容积V为
A. 0.25L
B. 4L
C. 0.4L
D. 1.6L
E. 16L

正确答案：B。4L

解析：本题考查表观分布容积的计算。由表观分布容积的计算公式：V=X/C，其中X为体内药物量，V是表观分布容积，C是血药浓度，代入X=80mg，C=20mg/L，求得V=X/C=80mg/20mg/L=4L（B对）。